下列物质含量异常可作为痛风诊断指证的是
A. 嘧啶
B. 嘌呤
C. β-氨基丁酸
D. 尿酸
E. β-丙氨酸

正确答案：D。尿酸

解析：尿酸是人体嘌呤（B错）分解代谢的终产物，当患者血中尿酸（D对）含量升高，超过8mg/100ml时，尿酸盐晶体即可沉积于关节、软组织、软骨及肾等处，引起痛风。嘧啶（Ａ错）是核酸合成的原料之一，β-丙氨酸（E错）是胞嘧啶分解产物，β-氨基异丁酸（C错）是胸腺嘧啶分解产物，三者均与痛风无关。